休克的下列主要临床表现哪一项是错误的？
A. 烦躁不安或表现淡漠甚至昏迷
B. 呼吸急促、脉搏细速
C. 尿少或无尿
D. 血压均下降
E. 面色苍白

正确答案：D。血压均下降

解析：烦躁不安或表现淡漠甚至昏迷（A对）、呼吸急促、脉搏细速（B对）、尿少或无尿（C对）、面色苍白（E对）都可以是休克的主要临床表现。微循环淤血期和微循环衰竭期血压均下降，但微循环缺血期血压可骤降（如大失血），也可略降，甚至因代偿作用可正常或轻度升高（D错，为本题正确答案），但是脉压会明显缩小，患者脏器有效灌流量明显减少。